球后穴位于眶下缘的
A. 外1/3与内2/3交点处
B. 内1/3与外2/3交点处
C. 直对瞳孔处
D. 外1/4与内3/4交点处
E. 内1/4与外3/4交点处

正确答案：D。外1/4与内3/4交点处

解析：球后乃经外奇穴，定位在面部，当眶下缘外1/4与内3/4交界处，而眶下缘的直对瞳孔处是承泣穴（D对，ABCE错）。